应激性溃疡发病基础不包括
A. 重度烧伤
B. 慢性胃炎
C. 颅内手术
D. 重度创伤
E. 脓毒血症

正确答案：B。慢性胃炎

解析：应激性溃疡是病人在遭受严重损伤、烧伤、大手术、重症感染以后或处于其他危重情况下，所发生的一种胃粘膜的急性浅表性糜烂或溃疡。重度烧伤（A对）、颅内手术（C对）、重度创伤（D对）、脓毒血症（E对）均是其发病基础。慢性胃炎（B错，为本题正确答案）一般不会出现危重病情，不是应激性溃疡的发病基础。